肉桂的主治病证是
A. 寒湿脚气
B. 亡阳欲脱
C. 气血亏虚
D. 下元虚冷
E. 虫积腹痛

正确答案：D。下元虚冷

解析：本题考查肉桂的主治病证。肉桂的主治病证是下元虚冷（D对）。肉桂【主治病证】（1）肾阳不足、命门火衰之阳痿、宫冷、畏寒肢冷。（2）下元虚冷、虚阳上浮之上热下寒证。（3）阳虚中寒之脘腹冷痛、食少便溏。（4）经寒血滞之痛经、闭经，寒疝腹痛，寒湿痹痛，腰痛。（5）阴疽，痈肿脓成不溃或久溃不敛。吴茱萸【主治病证】（1）中寒肝逆之头痛、吐涎沫。（2）寒湿脚气（A错）肿痛，或上冲人腹之腹胀、困闷欲死。（3）寒疝腹痛，经寒痛经。（4）呕吐吞酸。（5）虚寒腹痛泄泻。附子【主治病证】（1）亡阳欲脱（B错）。（2）肾阳不足、命门火衰之畏寒肢冷、阳痿、宫冷、尿频。（3）脾肾阳虚之脘腹冷痛、泄泻、水肿。（4）心阳虚衰之心悸、胸痹。（5）寒湿痹痛，阳虚外感。紫河车【主治病证】（1）肾虚精亏之不孕、阳痿、遗精、腰酸。（2）气血两亏之面色萎黄、消瘦乏力、产后少乳。（3）肺肾两虚之气喘咳嗽。（4）癫痫久发，气血亏虚（C错）。花椒【主治病证】（1）脘腹冷痛，中寒呕吐、泄泻。（2）虫积腹痛（E错），蛔虫、蛲虫所致者尤宜。（3）湿疹，阴痒。